小儿，壮热恶风，少汗，头痛，鼻塞流脓涕，咽红肿，口渴，小便短赤，大便秘结，舌苔糙而黄垢。治疗以辛凉解表为主，应加用
A. 槟榔、莱菔子
B. 枳实、厚朴
C. 生石膏、知母
D. 大黄、玄明粉
E. 神曲、山楂

正确答案：D。大黄、玄明粉

解析：患儿发热恶风，少汗，头痛，鼻塞流脓涕，咽红肿提示风热感冒；大便秘结，伴壮热，口渴，小便短赤，舌苔糙而黄垢，为食积郁而化热，形成阳明腑实证，故加大黄、枳实通腑泄热，大黄、玄明粉属于大承气汤的组成，具有通腑泄热，荡涤胃肠积滞的作用（D对）。槟榔、莱菔子（A错）均可消积导滞，适用于食积气滞、腹胀便秘等证。枳实、厚朴（B错）均可行气除满，适用于腹胀便秘等证。生石膏、知母（C错）均可清气分热，适用于气分热盛证。神曲、山楂（E错）均可消食，适用于食积证。